风湿性心脏瓣膜病的主要病因是
A. 七情所伤
B. 饮食不节
C. 禀赋不足
D. 劳倦体虚
E. 感受外邪

正确答案：E。感受外邪

解析：风心病主要因为感受外邪（E对）（风寒湿热等侵及人体），久留不去或反复侵袭，由表入里，内设于心阻痹经气，久之损伤心气脉络，心脉运行失畅所致。或因先天不足、年老体虚等正气虚弱，影响及心，致心气衰弱，气不行血，致气虚血瘀，或损及心阳、心阴，气血衰败，发为此病。七情所伤（A错）、饮食不节（B错）、禀赋不足（C错）、劳倦体虚（D错）不是风湿性心脏瓣膜病的主要病因。